梅毒的最主要传播途径是
A. 输血传播
B. 污染衣物传播
C. 通过性交经黏膜擦伤处传播
D. 通过接吻传播
E. 通过生产道感染

正确答案：C。通过性交经黏膜擦伤处传播